虚证的概念是
A. 以正气不足，抗病能力低下为主的病理反映
B. 正气不足，邪气亢盛的病理变化
C. 邪气亢盛，正气日衰，脏腑功能减退的病理反映
D. 正虚邪恋的病理反映
E. 以上都不是

正确答案：A。以正气不足，抗病能力低下为主的病理反映

解析：虚证是指正气不足，以正气虚损为矛盾主要方面的病机变化，机体的精气血津液不足或脏腑经络等生理功能减弱，抗病能力低下，因而机体的正气与致病邪气的斗争，难以出现较剧烈的反应，临床上表现一系列虚弱、衰退和不足的证候（A对）；正气不足、邪气亢盛，邪气亢盛、正气日衰、脏腑功能减退以及正虚邪恋均是虚实错杂的表现（BCD错）。